一个蛋白质与它的配体（或其他蛋白质）结合后，蛋白质的构象发生变化，使它更适合于功能需要，这种变化称为
A. 协同效应
B. 化学修饰
C. 激活效应
D. 共价修饰
E. 别构效应

正确答案：E。别构效应